患者的义务不包括
A. 及时就医
B. 早日康复
C. 遵守医疗部门规章制度
D. 遵守医嘱
E. 公开个人经济收入

正确答案：E。公开个人经济收入